始基囊肿好发于
A. 上颌前牙区
B. 上颌尖牙区
C. 上颌磨牙区
D. 上下颌双尖牙区
E. 下颌第三磨牙区及下颌支部

正确答案：E。下颌第三磨牙区及下颌支部

解析：始基囊肿、角化囊肿则好发于下颌第三磨牙区及下颌支部。掌握“牙源性颌骨囊肿”知识点。